列入国家二级重点保护野生药材物种的是
A. 羚羊角
B. 黄芩
C. 天麻
D. 丹参
E. 甘草

正确答案：E。甘草

解析：本题考查野生药材物种。列入国家二级重点保护野生药材物种的是甘草（E对）。二级保护野生药材物种系指分布区域缩小，资源处于衰竭状态的重要野生药材物种。二级保护药材名称：鹿茸（马鹿）、麝香（3个品种）、熊胆（2个品种）、穿山甲、蟾酥（2个品种）、哈蟆油、金钱白花蛇、乌梢蛇、蛤蚧、甘草（3个品种）、黄连（3个品种）、人参、杜仲、厚朴（2个品种）、黄柏（2个品种）、血竭。羚羊角（A错）为一级保护野生药材物种。黄芩（B错）为三级保护野生药材物种。天麻（C错）和丹参（D错）未列入国家重点保护的野生药材目录。